组成核酸的基本结构单位是
A. 碱基和核糖
B. 核糖和磷酸
C. 核苷酸
D. 脱氧核苷和碱基
E. 核苷和碱基

正确答案：C。核苷酸

解析：核苷酸是核酸的基本结构单位。掌握“核苷酸”知识点。